婚前医学检查的疾病不包括
A. 严重遗传性疾病
B. 精神分裂症
C. 狂躁抑郁型精神病
D. 艾滋病
E. 职业病

正确答案：E。职业病

解析：职业病不属于婚前医学检查的范畴（E错，为本题正确答案）。婚前医学检查对下列疾病进行检查：①严重遗传性疾病（A对）；②指定传染病，包括《中华人民共和国传染病防治法》中规定的艾滋病（D对）、淋病、梅毒以及医学上认为影响结婚和生育的其他传染病；③有关精神病，包括精神分裂症（B对）、狂躁抑郁型精神病（C对）以及其他重型精神病。